人的心理现象极其复杂，概括来说它主要包括既有联系又有区别的哪两大部分
A. 认知与情感
B. 情感与意志
C. 意志与人格
D. 人格与心理过程
E. 认知与人格特征

正确答案：D。人格与心理过程